羌活的功效是
A. 祛风解表，胜湿止痛，解痉
B. 祛风解表，止血
C. 解表散寒，祛风胜湿，止痛
D. 祛风湿，止痹痛，利水消肿
E. 祛风湿，止痹痛，通鼻窍

正确答案：C。解表散寒，祛风胜湿，止痛

解析：羌活辛温苦燥，升浮发散，气味雄烈，主入膀胱经，兼入肾经，药力较强。作用偏上偏表，主散肌表游风及寒湿而通利关节止痛，善治表证夹湿、太阳头痛及上半身风湿痹痛（C对）。功效为祛风解表，胜湿止痛，解痉（A错）的中药是防风。功效为祛风解表，止血（B错）的中药是荆芥，应注意荆芥生用解表散风，透疹消疮，炒炭之后才有收敛止血作用。功效为祛风湿，止痹痛，利水消肿（D错）的中药是防己。功效为祛风湿，止痹痛，通鼻窍（E错）的中药是苍耳子。